酸类药物制成脂类后其理化性质变化是
A. 脂溶性增大，易离子化
B. 脂溶性增大，不易透过生物膜
C. 脂溶性增大，刺激性增加
D. 脂溶性增大，易吸收
E. 脂溶性增大，与碱性药物增强

正确答案：D。脂溶性增大，易吸收

解析：本题考查药物的典型官能团对生物活性影响。羧酸药物成酯后，脂溶性增大，容易被吸收（D对），生物膜由磷脂双分子层构成，成酯后易透过生物膜（B错），此时药物不易解离，即不易离子化（A错）。药物成酯后，酸性下降，能够减少对胃肠道的刺激性（C错）。因为酸性药物成酯后不易解离，所以与碱性药物作用减弱（E错）。